男，32岁。反复发作无痛性肉眼血尿4年，多于上呼吸道感染后出现，间歇期尿RBC3～5/HP，无水肿及高血压。无肾脏病家族史。其血尿最可能的原因是
A. 肾小球肾炎
B. 尿路结石
C. 前列腺炎
D. 泌尿系结核
E. 尿路感染

正确答案：A。肾小球肾炎

解析：青年男性患者，反复发作无痛性肉眼血尿，多于上呼吸道感染（肾小球肾炎常见病因）后出现，其他症状均为阴性，结合患者病史及临床表现，该患者最可能的诊断为隐匿型肾小球肾炎（A对）。尿路结石（B错）多表现为疼痛伴血尿，一般无上呼吸道感染等诱因。前列腺炎（C错）多由尿道上行感染引起，主要表现为寒战、高热、尿频、尿急、尿痛等症状。泌尿系结核（D错）多继发于肺结核，典型表现为膀胱刺激症状伴终末血尿。尿路感染（E错）常有急性膀胱刺激症状，脓尿等。